心力衰竭临床表现产生的病理生理基础是：
A. 压力负荷过重
B. 容量负荷过重
C. 心输出量不足和回流障碍
D. 心肌能量代谢障碍
E. 心肌梗死

正确答案：C。心输出量不足和回流障碍

解析：心力衰竭的病因包括：心肌收缩性降低、心室负荷过重、心室舒张及充盈受限。压力负荷过重、容量负荷过重属于心室负荷过重，心肌能量代谢障碍、心肌梗死时的心肌细胞坏死可引起心肌收缩性降低。A、B、D、E选项是心力衰竭的病因，上述病因影响心脏正常生理功能，导致心输出量不足和回流障碍（C对）。